维生素D缺乏性佝偻病初期的临床表现是
A. 非特异性的神经兴奋性增高
B. 出牙延迟
C. 腕踝畸形
D. 下肢畸形
E. 颅骨软化

正确答案：A。非特异性的神经兴奋性增高

解析：初期（早期）多见于6个月以内，特别是＜3个月的婴儿，主要表现为非特异性的神经兴奋性增高症状，如易激惹，烦躁，睡眠不安，夜间惊啼，多汗（与季节无关），枕秃（因烦躁及头部多汗致婴儿常摇头擦枕）。掌握“维生素D缺乏性佝偻病”知识点。